磺胺类药物的鉴别方法有
A. Kober反应
B. 重氮化-偶合反应
C. 与硫酸铜的成盐反应
D. 硫色素反应
E. 三氯化铁反应

正确答案：B、C。重氮化-偶合反应；与硫酸铜的成盐反应